服用丙硫氧嘧啶过量致
A. 心率减慢
B. 体位性低血压
C. 甲状腺功能减退
D. 射精障碍
E. 乳腺增生

正确答案：C。甲状腺功能减退

解析：本题考查丙硫氧嘧啶使用过量所致的不良反应。丙硫氧嘧啶服用过量致甲状腺功能减退（C对）。丙硫氧嘧啶对结节性甲状腺肿合并甲状腺功能亢进者、甲状腺癌患者、过敏者禁用。应用过量，可引起甲状腺功能低下，应立即停药并进行检查。